五苓散属于“十剂”中的
A. 宣剂
B. 泄剂
C. 滑剂
D. 通剂
E. 湿剂

正确答案：D。通剂

解析：通剂，是指留滞之证，可以用通剂达到遁利的目的，即“通可去滞”，五苓散主治水蓄不行之证，属于通剂（D对）。